患者，男，35岁。1周前开始尿频、尿痛、尿急，伴有尿血，舌质红，苔薄黄，脉弦数。治疗应首选
A. 木通
B. 泽泻
C. 石韦
D. 车前子
E. 金钱草

正确答案：C。石韦

解析：患者尿频、尿痛、尿急，可诊断为淋证，治疗需利尿通淋；伴有尿血，舌质红，苔薄黄，脉弦数，治疗需凉血止血；首选利尿通淋，凉血止血的石韦（C对）。木通（A错）的功效是利尿通淋，清心除烦，通经下乳。可以用于治疗湿热淋证，水肿，小便不利。泽泻（B错）的功效是利水渗湿，泄热。车前子（D错）的功效是利尿通淋，渗湿止泻，清肝明目，清肺化痰。金钱草（E错）的功效是利湿退黄，利尿通淋，解毒消肿。